非典型苯丙酮尿症的发病原因是
A. 酪氨酸转氨酶缺乏
B. 苯丙氨酸转氨酶缺乏
C. 苯丙氨酸羟化酶缺乏
D. 酪氨酸羟化酶缺乏
E. 二氢生物蝶呤还原酶缺乏

正确答案：E。二氢生物蝶呤还原酶缺乏

解析：酪氨酸转氨酶缺乏（A错）可导致对羟苯丙酮酸生成减少，进一步导致体内尿黑酸生成减少。酪氨酸羟化酶缺乏（D错）可导致儿茶酚胺（多巴胺、去甲肾上腺素及肾上腺素）生成减少。典型苯丙酮尿症是因为苯丙氨酸羟化酶缺乏（C错），而不是苯丙氨酸转氨酶缺乏（B错）。二氢生物蝶呤还原酶缺乏（E对）可使苯丙氨酸羟化酶及酪氨酸羟化酶的辅酶四氢生物蝶呤生成减少，间接导致苯丙酮尿症及儿茶酚胺合成减少，是非典型苯丙酮尿症的发病原因。